室间隔缺损，房间隔缺损，动脉导管未闭及法洛四联症，上述的先天性心脏病患儿平时最常见的并发症是
A. 肺炎
B. 脑栓塞
C. 心律失常
D. 喉返神经麻痹
E. 感染性心内膜炎

正确答案：A。肺炎

解析：室间隔缺损，房间隔缺损，动脉导管未闭及法洛四联症这四种先天性心脏病的患儿均存在肺动脉压力高或分流等，常易反复发生呼吸道感染，如肺炎等，故上述的先天性心脏病患儿平时最常见的并发症是肺炎（A对）。而脑栓塞（B错）可出现于法洛四联症中，由于缺氧，刺激骨髓代偿性产生过多的红细胞，血液黏稠度高，血流缓慢，从而引起脑栓塞；心律失常（C错）可单独发病，亦可与后天各种器质性心脏病伴发，在先天性心脏病的后期中亦可出现，但不是患儿平时最常见的并发症；喉返神经麻痹（D错）是一种临床表现，而不是一个独立的疾病，即喉的运动神经（喉返神经）受到损害时出现的，以左侧最为多见，可由甲状腺手术、基底动脉瘤等引起；感染性心内膜炎（E错）可出现于室间隔缺损、动脉导管未闭及法洛四联症中，但不是患儿平时最常见的并发症。